治疗气秘，首选
A. 大黄附子汤
B. 麻子仁丸
C. 润肠丸
D. 六磨汤
E. 大承气汤

正确答案：D。六磨汤

解析：大黄附子汤可温里散寒，导滞通便，用来治疗冷秘（A错）。麻子仁丸可泻热导滞，润肠通便，用来治疗热秘（B错）。润肠丸可养血润肠，通便导滞，用来治疗血虚便秘（C错）。六磨汤可顺气散结，通便导滞，用来治疗气秘（D对）。大承气汤有峻下热结之功效，主治阳明腑实证（E错）。